某男，28岁，职业举重运动员。近2周因比赛将至，强化训练后，出现肛缘肿物隆起，灼热疼痛，咳嗽、行走、坐位时均可使疼痛加剧，小便黄，大便干燥，排便时可见少量鲜血；舌红，苔黄腻，脉弦数，诊断为痔疮。患者用药治疗期间，仍坚持训练，一天突发肛内肿物脱出，嵌顿，坠胀疼痛，医师检查发现肛缘水肿，血栓形成，触痛明显。宜选
A. 槐角丸
B. 麻仁胶囊
C. 痔康片
D. 脏连丸
E. 痔宁片

正确答案：E。痔宁片

解析：本题考查痔之气滞血瘀证的常用中成药。结合患者症状为痔之气滞血瘀证，宜选用的中成药是痔宁片（E对）。痔之气滞血瘀证【症状】内痔常见肛内肿物脱出，甚至嵌顿，肛管紧缩，坠胀疼痛，甚则肛缘水肿、血栓形成，触痛明显。外痔可见肛缘肿物突起，排便时可增大，有异物感，可有胀痛或坠痛，局部可触及硬性结节。舌质暗红，苔白或黄，脉弦或涩。【中成药应用】马应龙麝香痔疮膏、痔宁片。痔之风伤肠络证【症状】大便带血，滴血或喷射状出血，血色鲜红，或有肛门瘙痒。舌质红，苔薄白或薄黄，脉浮数。【中成药应用】槐角丸（A错）、痔疮片、痔康片（C错）、参蛇花痔疮膏。便秘之热秘【症状】大便干结，腹胀腹痛，口干口臭，面红心烦，或有身热，小便短赤。舌红，苔黄燥，脉滑数。【中成药应用】麻仁胶囊（B错）、麻仁润肠丸、麻仁滋脾丸、通幽润燥丸、清泻丸、复方芦荟胶囊。痔之湿热下注证【症状】内痔可见便血色鲜红，量较多，肛内肿物外脱，可自行回缩，肛门灼热。外痔可见肛缘肿物隆起，灼热疼痛，咳嗽、行走、坐位均可使疼痛加剧，便干或溏，溲赤。舌质红，苔黄腻，脉弦数。【方剂应用】脏连丸（D错）。